建议在妊娠12周前行人工流产的心脏病类型是
A. 动脉导管未闭
B. 轻度室间隔缺损
C. 二尖瓣狭窄伴肺动脉高压
D. 二尖瓣狭窄行人工球囊扩张术后
E. 二尖瓣关闭不全

正确答案：C。二尖瓣狭窄伴肺动脉高压

解析：二尖瓣狭窄伴有肺动脉高压患者，因血流动力学改变明显，肺水肿和心力衰竭发生率高，孕妇与胎儿死亡率高，故应在妊娠前纠正二尖瓣狭窄，已妊娠者宜早期终止妊娠（C对）。二尖瓣狭窄行人工球囊扩张术后（D错），血流动力学改变被有效改善，患者可以耐受妊娠。动脉导管未闭（A错）者未闭动脉导管口径较小，肺动脉压正常者，妊娠期一般无症状，可继续至妊娠足月。轻度室间隔缺损（B错）时，较少发生肺动脉高压和心力衰竭，一般能顺利度过妊娠与分娩期。二尖瓣关闭不全（E错）患者由于妊娠期外周阻力下降，使二尖瓣反流程度减轻，故一般情况下能较好的耐受妊娠。